男孩，5岁。自幼唇指（趾）甲床青紫，乏力，活动后气促，体格发育落后，胸骨左缘第2～3肋间可闻及Ⅲ级收缩期杂音，经超声心动图证实为先天性心脏病，法洛四联症。此患儿其心脏由哪4种畸形组成
A. 主动脉狭窄，室间隔缺损，肺动脉骑跨，右心室肥厚
B. 主动脉狭窄，房间隔缺损，主动脉骑跨，左心室肥厚
C. 肺动脉狭窄，室间隔缺损，主动脉骑跨，右心室肥厚
D. 肺动脉狭窄，房间隔缺损，肺动脉骑跨，左心室肥厚
E. 肺动脉狭窄，房间隔缺损，主动脉骑跨，右心室肥厚

正确答案：C。肺动脉狭窄，室间隔缺损，主动脉骑跨，右心室肥厚

解析：法洛四联症心脏的4种畸形组成是肺动脉狭窄（右心室流出道梗阻），室间隔缺损，主动脉骑跨，右心室肥厚（C对）。